按照化学结构分类，皂苷的结构类型有
A. 甾体皂苷
B. 黄酮皂苷
C. 木脂素皂苷
D. 三萜皂苷
E. 环烯醚萜皂苷

正确答案：A、D。甾体皂苷；三萜皂苷

解析：本题考查的是皂苷的结构类型。按照化学结构分类，皂苷的结构类型有甾体皂苷（A对）与三萜皂苷（D对）。皂苷是一类结构复杂的苷类化合物，其苷元为具有螺甾烷及其有相似生源的甾族化合物或三萜类化合物。皂苷的结构可分为苷元和糖两个部分。如果苷元为三萜类化合物则称为三萜皂苷，苷元为螺甾烷类化合物，则称为甾体皂苷。